下列关于学校的选址要求，哪一项是不正确的
A. 学校应设在居民区适中的地方
B. 学校教学用房与铁路的间隔不应小于300m
C. 学校宜设在科学、教育、文化、体育等设施的附近
D. 学校应选在阳光充足、空气流通、地势较高的路段
E. 学校用地面积要为学校的发展留有余地

正确答案：E。学校用地面积要为学校的发展留有余地